我国规定凡被确诊为法定职业病者需给予以下规定的待遇，除了
A. 凡经各级政府指定的诊断组确诊方后享受劳保待遇
B. 经诊断组确诊者应向主管部门报告，并享受劳保待遇
C. 凡经诊断组确诊为工伤、致残、死亡者应给予劳保待遇
D. 法定职业病患者住院治疗期间照发工资
E. 法定职业病患者在家休息期间不得享受劳保待遇

正确答案：E。法定职业病患者在家休息期间不得享受劳保待遇